正确的是
A. 心大静脉与前室间支伴行
B. 心中静脉与后室间支伴行
C. 心小静脉注入冠状窦右端
D. 心最小静脉直接注入心脏各腔
E. 以上均正确

正确答案：E。以上均正确

解析：心大静脉与左冠状动脉前室间支伴行（A对）。心中静脉与右冠状动脉后室间支伴行（B对）。心小静脉注入冠状窦右端（C对）。心最小静脉直接注入心脏各腔（D对）。（ABCD对，故E为本题正确答案）。